胚胎第6周时，如甲状舌导管不消失或发育异常可导致
A. 牙源性角化囊肿
B. 甲状舌管囊肿
C. 畸胎样囊肿
D. 鼻唇囊肿
E. 含牙囊肿

正确答案：B。甲状舌管囊肿

解析：胚胎第4周甲状腺始基（甲状舌管）下行，在甲状软骨处发育成甲状腺。胚胎第6周时此管开始退化，消失。如甲状舌导管不消失或发育异常可导致各种病损，如甲状舌管囊肿、甲状舌管瘘或甲状腺迷走组织等。掌握“甲状舌管囊肿”知识点。